按照需要起源，可把需要分为
A. 生物性需要和社会性需要
B. 生理性需要和心理性需要
C. 自然需要和精神需要
D. 物质需要和精神需要
E. 物质需要和心理需要

正确答案：A。生物性需要和社会性需要

解析：人的需要表现为多种多样，非常复杂。按需要的起源和发展，可将人的需要分为生物性需要和社会性需要。掌握“需要与动机”知识点。